与DNA结合并阻止转录进行的蛋白质称为
A. 正调控蛋白
B. 反式作用因子
C. 诱导物
D. 阻遏物
E. 分解代谢基因活化蛋白

正确答案：D。阻遏物